女，60岁。不慎路滑跌倒，右臀部着地，扶起不能行走。右股部明显压痛。经x线摄片诊断为右股骨颈骨折。其右下肢畸形的位置应是
A. 屈曲内旋
B. 屈曲外旋
C. 屈曲内收
D. 延长内旋
E. 缩短外旋

正确答案：E。缩短外旋

解析：股骨颈骨折患者由于承重关系，可导致患肢所短；此外，可发现患肢出现外旋畸形，一般在45°～60°之间，这是因为骨折远端失去了关节囊及髂股韧带的稳定作用，同时受到附着于大转子的臀中、小肌和臀大肌及附着于小转子的髂腰肌和内收肌群的牵拉（E对D错）。屈曲内收、内旋（P655）（AC错）见于髋关节后脱位，其表现为患肢缩短，髋关节呈屈曲位、内收、内旋畸形。屈曲外旋（P656）（B错）见于髋关节前脱位，其表现为患肢呈外展、外旋和屈曲畸形。